子宫内膜不规则脱落时，应为
A. 月经第5～6日刮宫见子宫分泌反应内膜
B. 经前2日刮宫见子宫内膜分泌反应不良
C. 经前3日刮宫见子宫内膜增生期改变
D. 经前2日刮宫见子宫内膜分泌期改变
E. 刮宫为蜕膜

正确答案：A。月经第5～6日刮宫见子宫分泌反应内膜

解析：子宫内膜不规则脱落属于排卵性月经失调分类中的黄体功能异常，其特点是月经周期有排卵，黄体发育良好，但萎缩过程延长，导致子宫内膜不规则脱落，月经第5～6日仍能见到呈分泌反应的子宫内膜（A对BCD错）。蜕膜是受精卵着床后的子宫内膜（E错）。